与压力触觉感受相关的
A. 黑色素细胞
B. 朗格汉斯细胞
C. 梅克尔细胞
D. 成纤维细胞
E. 角质细胞

正确答案：C。梅克尔细胞

解析：本题考查非角质细胞。与压力触觉感受相关的梅克尔细胞（C对）。1.有角化的口腔上皮由4层角质细胞构成，从深层至表面依次为：基底层、棘层、颗粒层和角化层。角质细胞（E错）产生的细胞因子可以调节朗格汉斯细胞的功能；角质细胞形成的细胞因子也能影响邻近结缔组织成纤维细胞的生长、原纤维和基质蛋白的形成。2.非角质细胞：（1）黑素细胞（A错）：位于基底层，呈树突状，来源于神经嵴。其功能是形成黑色素，可通过细胞突起传给角质细胞。上皮基底细胞与黑素细胞之比为7：1。（2）朗格汉斯细胞（B错）：位于基底层或基底层上部，是一种有树枝状突起的细胞，胞质内有特殊的朗格汉斯颗粒。目前认为是上皮内的调节细胞，调控上皮细胞的分裂和分化，与免疫递呈功能及上皮角化亦有密切关系。（3）梅克尔细胞：此细胞位于基底层，常成群分布，可能来自于神经嵴或上皮细胞。此种细胞是一种压力或触觉感受细胞。3.成纤维细胞（D错）：形态与机体其他处的成纤维细胞相同，有合成和更新纤维及基质的功能。成人口腔黏膜的成纤维细胞增殖率较低，但在创伤愈合时数量增加，此时的成纤维细胞中肌动蛋白含量增加，有收缩功能。某些疾病状态下应用苯妥英、钙离子通道阻断剂硝苯地平和环孢素，器官移植时应用的免疫抑制剂等可以激活成纤维细胞，导致牙龈的增生。成纤维细胞中还含有固有层的干细胞。